颌面部挫裂伤而出现活动性出血
A. 钳夹、结扎止血法
B. 区域阻断止血法
C. 填塞止血法
D. 低温、降压止血法
E. 电灼止血法下列出血情况应选用的正确止血方法是

正确答案：A。钳夹、结扎止血法

解析：钳夹、结扎止血法是常用而可靠的止血方法。对于创口活跃出血的血管断端都应该以钳夹、结扎止血。掌握“口外手术组织切开、止血及组织分离”知识点。